上颌神经在颅中窝段发出的神经是
A. 颧神经
B. 翼腭神经
C. 腭神经
D. 脑膜中神经
E. 上牙槽后神经

正确答案：D。脑膜中神经

解析：上颌神经颅中窝段：发出脑膜中神经，分布于硬脑膜。掌握“三叉神经的分支与分布”知识点。